不符合乙状结肠扭转临床特点的是
A. 呕吐早且频繁
B. 可见不对称腹胀或肠型
C. 钡灌肠造影呈“鸟嘴”形
D. 腹部压痛及肌紧张不明显
E. 腹部X线可见马蹄状充气肠袢

正确答案：A。呕吐早且频繁

解析：乙状结肠扭转的临床特点包括：多见于乙状结肠冗长、有便秘的老年人，以往可有多次腹痛发作经排气、排便后缓解的病史。病人有腹部持续胀痛，左腹部明显膨胀，可见肠型（B对）。腹部压痛及肌紧张不明显（D对）。腹部X线平片显示马蹄状巨大的双腔充气肠袢，圆顶向上（E对）；立位可见两个液平面。钡剂灌肠X线检查见扭转部位钡剂受阻，钡影尖端呈“鸟嘴”（C对）。呕吐早且频繁为高位肠梗阻而非乙状结肠扭转的临床表现（A错，为本题正确选项）。